阿托品不能引起
A. 心率加快
B. 眼内压下降
C. 口干
D. 视力模糊
E. 扩瞳

正确答案：B。眼内压下降

解析：本题考查阿托品。阿托品为M受体阻断剂，随剂量的增加可依次出现腺体分泌减少（C对）、瞳孔散大、调节麻痹、胃肠道平滑肌松弛、心率加快（A对）等。阿托品对眼的作用主要是散瞳（E对）视力模糊（D对）、升高眼内压（B错，为本题正确答案）、调节麻痹。